主治风痰上扰证的方剂是
A. 二陈汤
B. 定喘汤
C. 大定风珠
D. 大秦艽汤
E. 半夏白术天麻汤

正确答案：E。半夏白术天麻汤

解析：主治风痰上扰证的是半夏白术天麻汤（E对）。二陈汤主治湿痰证（A错）。定喘汤主治风寒外束，痰热内蕴证（B错）。大定风珠主治阴虚风动证（C错）。大秦艽汤主治风邪初中经络证（D错）。